粘接固定桥的固位是依靠
A. 摩擦力
B. 酸蚀，粘接技术
C. 卡环
D. 吸附力
E. 粘接和卡环

正确答案：B。酸蚀，粘接技术

解析：本题考查粘接固定桥的固位。粘接固定桥是利用酸蚀、复合树脂粘接技术将固定桥的固位体直接粘接在缺隙两侧的基牙上，其固位主要依靠粘接材料的粘接力（B对），而预备体上的固位形只起辅助的固位作用，这一点是粘结固定桥最大的特点。粘接固定桥具有磨除牙体组织少，患者易于接受，不显露金属或极少暴露金属的优点，容易更改为其他固定桥设计。摩擦力（A错）不是粘接固定桥的主要固位力。固定桥由固位体、桥体、连接体三部分组成，并不存在卡环（CE错）。基托组织面和黏膜紧密贴合，其间有一薄层的唾液吸附力，基托组织面与唾液、唾液与黏膜之间产生了吸附力，而固定桥没有基托，不存在吸附力（D错）。